1岁婴儿，面色苍黄，毛发稀疏，易怒少哭。查体：体温正常，神清，不会扶站，四肢抖动，踝阵挛，巴氏征（+）。该患婴的诊断可能是
A. 先天愚型
B. 多动症
C. 病毒性脑膜炎
D. 癫痫小发作
E. 巨幼细胞性贫血

正确答案：E。巨幼细胞性贫血

解析：该患儿出现了巨幼细胞贫血神经症状：不会扶站，四肢抖动，踝阵挛，巴氏征（+）（E对）。先天愚型的特殊面容为表情呆滞，眼裂小，眼距宽，双眼外眦上斜，鼻梁低平，外耳小，硬腭窄小，常张口伸舌，头小而圆，前囟大且未闭（A错）。多动症年龄高发期为6～15岁。脑功能轻微失调，表现注意力不集中，活动过多，情绪易冲动（B错）。病毒性脑膜炎多有上呼吸道感染史，表现为剧烈头痛，发热，颈强直，腹痛，寒战（C错）。